动脉导管解剖闭合80%发生于
A. 3个月内
B. 5个月内
C. 6个月内
D. 9个月内
E. 1岁以内

正确答案：A。3个月内